炙甘草汤和归脾汤均可用治
A. 脾肺气虚，自汗易感者
B. 脾胃气虚，食少脘胀者
C. 气血不足，心悸怔忡者
D. 脾阳不足，吐衄便血者
E. 肝肾不足，腰膝酸软者

正确答案：C。气血不足，心悸怔忡者

解析：炙甘草汤证是由阴血不足，阳气虚弱所致。气血俱虚，心失所养，故心悸怔忡。方中重用生地黄滋阴养血为君，配伍炙甘草、人参、大枣益心气，补脾气，以资气血生化之源；阿胶、麦冬、麻仁滋心阴，养心血，充血脉，共为臣药。佐以桂枝、生姜辛行温通，温心阳，通血脉，用法中加清酒煎服，以清酒辛热，可温通血脉，以行药力，是为使药。归脾汤证多因思虑过度，劳伤心脾，气血日耗所致。心脾气血暗耗，神无所主，意无所藏，故见心悸怔忡。方中黄芪甘温，益气补脾，龙眼肉甘平，既补脾气，又养心血以安神，为君药。人参、白术补脾益气，助黄芪益气生血；当归补血养心，助龙眼肉养血安神，为臣药；茯神、酸枣仁、远志宁心安神；木香辛香而散，理气醒脾，与大量益气健脾药配伍，补而不滞，滋而不腻，为佐药。炙甘草补气调中，为佐使药。用法中姜、枣调和脾胃，以资化源（C对）。